胸骨明显压痛或叩击痛常见的疾病是
A. 上呼吸道感染
B. 肺炎
C. 慢性支气管炎
D. 肺结核
E. 白血病

正确答案：E。白血病

解析：白血病（E对）患者常有胸骨下段的局部压痛，主要是由于骨髓内白血病细胞大量增殖，引起骨髓腔容积压力增高所致。上呼吸道感染（P13）（A错）表现为咳嗽、喷嚏、咽痛、发热等症状，无胸骨疼痛。肺炎（P42）（B错）表现为咳嗽、咳痰、或原有呼吸道症状加重、并出现脓性痰或血痰，伴或不伴胸痛。慢性支气管炎（P20）（C错）表现为咳嗽、咳痰、喘息或气急，背部或肺底可闻及干、湿啰音。肺结核（P64）（D错）表现为咳嗽、咳痰两周以上或痰中带血，低热、乏力、盗汗等。